男性，24岁。反复发作性咳嗽喘息10年余，再发加重3小时。查体见意识模糊，口唇发绀，双肺呼吸音明显减低，未闻及干湿啰音，心率128次/分，可触及奇脉。诊断及病情程度确定后应采取的最有效措施是
A. 甲基强的松龙静滴+氨茶碱静滴+氧疗
B. 特布他林口服+氨茶碱口服+氧疗
C. 亚胺培南静滴+氨茶碱静滴+氧疗
D. 沙丁胺醇吸入+氨茶碱口服+氧疗
E. 倍氯米松吸入+氨茶碱静滴+氧疗

正确答案：A。甲基强的松龙静滴+氨茶碱静滴+氧疗

解析：患者为青年男性，有反复发作性咳嗽喘息史，考虑为支气管哮喘。此次意识模糊，触及奇脉，考虑为支气管哮喘急性发作期的危重程度，对于危重程度的病人，需要静脉静滴糖皮质激素以及氨茶碱迅速缓解病情，吸氧为常规治疗（A对BDE错）。亚胺培南（C错）是碳青霉烯类抗生素，支气管哮喘不是细菌感染性疾病，若无合并感染，不宜使用。